坐骨神经分布于
A. 臀大肌
B. 股二头肌
C. 大腿外侧皮肤
D. 大腿内侧皮肤
E. 臀中肌

正确答案：B。股二头肌

解析：臀下神经支配臀大肌（A错）。坐骨神经支配股二头肌（B对）、半腱肌和半膜肌。大腿外侧皮肤（C错）由股神经支配。大腿内侧皮肤（D错）由闭孔神经支配。臀中肌（E错）由臀上神经支配。